由两个正常牙胚的釉质或牙本质融合在一起而成的牙齿被称为
A. 双生牙
B. 结合牙
C. 融合牙
D. 畸形中央尖
E. 畸形舌窝

正确答案：C。融合牙

解析：融合牙：是由两个正常牙胚的釉质或牙本质融合在一起而成。结合牙：是2个或2个以上基本发育完成的牙齿，由于牙齿拥挤创伤，使两个牙根靠拢，有增生的牙骨质将其结合在一起而成。双生牙：是牙胚在发育期间，成釉器内陷将牙胚分开而形成的畸形牙，表现为牙冠完全或不完全分开，但是有一个共同的牙根和根管。掌握“迟萌、多生牙和融合牙”知识点。